《中国药典》规定，橡胶贴膏应检查
A. 耐热性
B. 软化点
C. 赋形性
D. 粒度
E. 溶出度

正确答案：A。耐热性

解析：本题考查的是橡胶贴膏的质量要求。《中国药典》规定，橡胶贴膏应检查耐热性（A对）。耐热性：除另有规定外，橡胶贴膏取供试品2片，除去盖衬，在60℃加热2小时，放冷后，背衬应无渗油现象；膏面应有光泽，用手指触试应仍有黏性。膏药的软化点（B错）须符合《中国药典》规定。赋形性（C错）：取凝胶贴膏供试品1片，置37℃、相对湿度64%的恒温恒湿箱中30分钟，取出，用夹子将供试品固定在一平整钢板上，钢板与水平面的倾斜角为60°，放置24小时，膏面应无流淌现象。粒度（D错）：除另有规定外，混悬型软膏剂、含饮片细粉的软膏剂按照《中国药典》粒度和粒度分布测定法测定，均不得检出大于180μm的粒子。溶出度（E错）：除另有规定外，胶囊剂、混悬颗粒剂、分散片及以难溶性原料药物制成的口崩片需要进行溶出度检查。